制备甾体激素类药物溶液时，加入的表面活性剂是作为
A. 潜溶剂
B. 增溶剂
C. 絮凝剂
D. 消泡剂
E. 助溶剂

正确答案：B。增溶剂

解析：本题考查表面活性剂。制备甾体激素类药物溶液时，加入的表面活性剂具有增溶（B对）的作用。潜溶剂（A错）指能提高难溶性药物溶解度的混合溶剂；絮凝剂（C错）多数为聚合物，并有特定的电性（离子性）和电荷密度（离子度）；消泡剂（D错）是可消除泡沫的物质；难溶性药物与加入的第三种物质在溶剂中形成可溶性分子间的络合物、缔合物或复盐等，以增加药物在溶剂中的溶解度，第三种药物即为助溶剂（E错）。